高输出性心力衰竭病人的血流动力学特点是
A. 心衰时心输出量比心衰前有所增加，可稍高于正常水平
B. 心衰时心输出量比心衰前有所降低，但可高干正常水平
C. 心衰时心输出量比心衰前有所增加，但低于正常水平
D. 心衰时心输出量比心衰前有所降低，但低于正常水平
E. 以上说法都不正确

正确答案：B。心衰时心输出量比心衰前有所降低，但可高干正常水平

解析：高输出性心力衰竭可见于严重贫血、妊娠、甲状腺功能亢进、动静脉瘘、维生素B1缺乏症等。上述疾病可使外周血管阻力降低、血容量扩大或循环速度加快，引起静脉回心血量增加，心脏过度充盈，在代偿阶段出现心输出量明显增加、外周组织高灌注的高动力循环状态。但长期的高动力循环状态使心脏容量负荷过重，一旦从代偿发展为失代偿，心输出量较失代偿前降低，但可高于正常水平（B对）。